舍曲林用于治疗
A. 惊厥
B. 帕金森病
C. 抑郁症
D. 痛风
E. 记忆障碍

正确答案：C。抑郁症

解析：本题考查舍曲林。舍曲林（C对）为选择性5-HT再摄取抑制剂，通过抑制5-HT再摄取，使突触间隙5-HT含量升高而发挥抗抑郁作用。惊厥（A错）是由各种原因引起的中枢神经过度兴奋，表现为全身骨骼肌不自主的强烈收缩。帕金森病（B错）是由于中枢纹状体DA含量降低，脊髓前角运动神经元的兴奋性增高而引起的中枢神经系统疾病。痛风（D错）是体内嘌呤代谢紊乱引起的一种疾病。记忆障碍（E错）是由中枢乙酰胆碱及其受体减少引起的一种疾病。